出血性脑卒中急性期患者减轻脑水肿可选用的药品有
A. 甘露醇
B. 甘油果糖
C. 呋塞米
D. 螺内酯
E. 氢氯噻嗪

正确答案：A、B、C。甘露醇；甘油果糖；呋塞米

解析：本题考查出血性脑血管病用药。出血性脑卒中急性期患者减轻脑水肿可选用的药品有甘露醇（A对）或甘油果糖（B对）、呋塞米（C对）。螺内酯（D错）属于利尿药，用于治疗水肿性疾病和原发性醛固酮增多症，作为治疗高血压的辅助药物及低钾血症的预防。氢氯噻嗪（E错）为利尿药、抗高血压药。